以下属于中龋临床表现的是
A. 遭受外界的物理化学刺激无明显反应
B. 已有龋洞，龋损的前沿位于牙本质的浅层
C. 已有龋洞，进食冷、热或酸、甜食品疼、自发疼
D. 已有龋洞，进食冷、热或酸、甜食品疼、放射疼
E. 已有龋洞，进食冷、热或酸、甜食品疼、夜间疼

正确答案：B。已有龋洞，龋损的前沿位于牙本质的浅层

解析：中龋龋损的前沿位于牙本质的浅层，又称为牙本质浅龋。临床检查时已有明显的龋洞，X线片上可发现由牙表面至牙本质浅层的透射影。龋洞内有龋腐，患牙开始出现症状，主要表现为在进食冷、热或酸、甜食品时，刺激进入窝洞引起的一过性敏感症状，去除刺激后症状随即消失。掌握“龋病的临床表现与分类”知识点。